男性，45岁。因突然呕血入院。10年前患有乙肝，因肝功能损害曾多次住院治疗。近期感腹胀、乏力。查体：脾肿大，腹水。应首先考虑的是
A. 肺结核慢性空洞咯血
B. 胃溃疡出血
C. 急性支气管炎出血
D. 肝硬化食管下端静脉丛破裂出血
E. 十二指肠溃疡出血

正确答案：D。肝硬化食管下端静脉丛破裂出血

解析：患者中年男性，10年前患有乙肝（肝硬化最常见的病因），多次发生肝功能损害，近期有腹胀、乏力，查体见脾肿大、腹水（门脉高压的典型表现），出现突发呕血入院，应首先考虑的是肝硬化食管下端静脉丛破裂出血（D对）。肺结核慢性空洞咯血（P64）（A错）的患者常表现为长期咳嗽、咳痰伴痰液量多，有午后潮热、盗汗、体重减轻等症状。胃溃疡出血（P370）（B错）、十二指肠溃疡出血（P370）（E错）的患者主要表现为上腹痛或不适，呈周期性发作，且疼痛与进餐之间具有节律性（如饥饿痛、餐后痛）。急性支气管炎出血（P17）（C错）通常起病急，咳嗽、咳痰明显，体征大多正常。